一项病例对照研究中，500个病例中有暴露史者400人，而500个对照中有暴露史者100人，有暴露史者的发病率为
A. 0.8
B. 0.4
C. 0.2
D. 无法计算

正确答案：D。无法计算

解析：本题考查病例对照研究的关联强度分析指标。描述暴露与疾病联系强度的指标是相对危险度，但病例对照研究中没有暴露组和非暴露组的观察人数，不能计算发病率（D对ABC错），因此不能直接计算相对危险度。可用比值比来近似估计RR。